下列关于中国居民平衡膳食宝塔的叙述不正确的是
A. 谷类食物在底层，每人每天应该吃250~400g
B. 蔬菜和水果在第二层，每天应分别吃300~500g和200~ 400g
C. 鱼、禽、肉、蛋等动物性食物在第三层，每天应该吃125~225g
D. 奶类和豆类食物在第四层，每天应吃相当于鲜奶300g的奶类及奶制品和相当于干豆30~ 50g的大豆类及坚果
E. 第五层塔顶是烹调油和食盐，每天烹调油不超过25g或30g，食盐不超过6g，食糖不超过人体总能量消耗的5%

正确答案：E。第五层塔顶是烹调油和食盐，每天烹调油不超过25g或30g，食盐不超过6g，食糖不超过人体总能量消耗的5%